2周岁儿童体重、身长约为
A. 10Kg、80cm
B. 12kg、89cm
C. 14Kg、90cm
D. 16Kg、95cm
E. 18Kg、100cm

正确答案：B。12kg、89cm

解析：第十版中医儿科学小儿身高计算公式为：身高（cm）=70+7×年龄。2022年中医执业医师考试指导用书（2022中医执业考试大纲）将小儿身高计算公式纠正为：身高（cm）=75+7×年龄。以新大纲为主，2岁小儿的体重为8+2×2=12Kg，身高为75+7×2=89cm（B对）。